为预防神经管畸形儿的发生，孕前及孕早期需要注意补充的维生素是
A. 钙
B. 碘
C. 维生素B₁
D. 维生素C
E. 叶酸

正确答案：E。叶酸

解析：本题考查为预防神经管畸形儿的发生，孕前及孕早期需要注意补充的维生素。叶酸缺乏可影响胚胎细胞增殖、分化，增加神经管畸形及流产的风险。为预防神经管畸形儿的发生，孕前及孕早期需要注意补充的维生素是叶酸（E对ABCD错）。